白芍主产地是
A. 浙江
B. 福建
C. 河南
D. 吉林
E. 江苏

正确答案：A。浙江

解析：本题考查的是白芍的产地。白芍主产地是浙江（A对）。白芍：【产地】主产于浙江、安徽、四川、贵州、山东等省，均系栽培。主产地为福建（B错）的药材有泽泻、桑寄生、薏苡仁、青黛等。主产地为河南（C错）的是怀药。怀药：主产地河南。如著名的“四大怀药”——地黄、牛膝、山药、菊花；以及天花粉、瓜蒌、白芷、辛夷、红花、金银花、山茱萸等。主产地为吉林（D错）的药材有人参、五味子、鹿茸等。主产地为江苏（E错）的药材有虎杖、太子参、威灵仙、木通、侧柏叶、紫苏叶、洋金花、地肤子、菟丝子等。